悬饮咳唾胸胁引痛，心下痞硬，干呕短气，脉沉弦者，治疗应选用
A. 五苓散
B. 十枣汤
C. 实脾散
D. 真武汤
E. 五皮散

正确答案：B。十枣汤

解析：十枣汤方含芫花、甘遂、大戟和大枣，可攻逐水饮，故可主治咳唾胸胁引痛，心下痞硬，干呕短气等之悬饮（B对），还可治一身悉肿，腹胀喘满，二便不利等水肿（实水）。五苓散功效利水渗湿，温阳化气，主治蓄水证、痰饮、水湿内停证（A错）。实脾散功效温阳健脾，行气利水，主治脾肾阳虚，水气内停之阴水（C错）。真武汤功效温阳利水，主治阳虚水泛证（D错）。五皮散功效利水消肿，理气健脾，主治水停气滞之皮水证（E错）。